对怀疑霍乱病人最有诊断意义的检查是
A. 血培养
B. 粪便培养
C. 粪便检查病原菌
D. 血清凝集试验
E. 结肠镜检查

正确答案：B。粪便培养